乌鸡白凤丸的功能是
A. 理气和血，调经止痛
B. 滋阴清热，固经
C. 补气养血，调经止带
D. 疏肝健脾，养血调经
E. 补血调经，清热利湿

正确答案：C。补气养血，调经止带

解析：本题考查的是乌鸡白凤丸的功能。乌鸡白凤丸的功能补气养血，调经止带（C对）。乌鸡白凤丸：【功能】补气养血，调经止带。女金丸：【功能】益气养血，理气活血，止痛。女金丸既补益气血，又理气活血，为补通兼用、药力均衡之剂，功能益气养血、理气活血、调经止痛（A错）。固经丸：【功能】滋阴清热，固经（B错）止带。逍遥颗粒：【功能】疏肝健脾，养血调经（D错）。补血调经，清热利湿（E错）的中成药，2022年考试指南未明确说明。